新斯的明对胃肠膀胱的作用是
A. 直接作用于受体
B. 影响递质的储存
C. 影响代谢酶
D. 影响递质的释放
E. 影响递质的生物合成

正确答案：C。影响代谢酶

解析：新斯的明的作用机制为：新斯的明与胆碱酯酶结合的步骤与乙酰胆碱相似。新斯的明以季铵阳离子与AchE的阴离子部位结合，分子中的羰基碳与AchE酯解部位的丝氨酸的羟基形成共价键，形成复合物；然后再生成二甲胺基甲酰化胆碱酯酶，后者的水解速度较乙酰化胆碱酯酶的水解速度为慢，故酶被抑制的时间较长；最后二甲胺基甲酰化胆碱酯酶被水解，分离出二甲胺基甲酸，胆碱酯酶活性得以恢复（C对）。